对脑部血管性病变和肿瘤供血情况诊断价值较大的技术
A. 颅脑CT
B. 颅脑MRI
C. 脑血管造影数字减影（DSA）
D. 正电子发射断层扫描（PET）
E. 脑电图（EEG）

正确答案：C。脑血管造影数字减影（DSA）

解析：脑血管造影DSA对脑及脊髓的血管性病变和肿瘤供血情况的诊断价值较大。掌握“颅内肿瘤”知识点。